蛋白质-热能营养不良患儿皮下脂肪逐渐减少或消失，首先累及的部位是
A. 四肢
B. 臀部
C. 腹部
D. 胸部
E. 面颊部

正确答案：C。腹部

解析：腹部（C对）是蛋白质-热能营养不良患儿皮下脂肪逐渐减少或消失首先累及的部位。